43岁，继发性痛经6年，子宫约妊娠12周大小。B超检查，子宫肌层可见大小不等的结节。治疗方法应选择
A. 药物治疗
B. 保留生育功能手术
C. 根治性手术
D. 饮食注意
E. 无需处理

正确答案：C。根治性手术

解析：该患者43岁（近绝经年龄，大部分妇女绝经年龄在44～54岁之间），继发性痛经6年，子宫约妊娠12周大小，B超检查，子宫肌层可见大小不等的结节，考虑为子宫腺肌病。患者症状较重，应行根治性手术（C对）。药物治疗（A错）只能缓解症状，不能根治，适用于症状较轻、有生育要求及近绝经期患者。保留生育功能手术是将病灶挖除，但术后有复发风险，适用于年轻或希望生育的患者。